米帕明不具有哪种作用
A. 有明显的抗抑郁作用
B. 有阻断M胆碱受体作用
C. 对心肌有奎尼丁样作用
D. 促进突触前膜对去甲肾上腺素及5-HT的再摄取
E. 降低血压

正确答案：D。促进突触前膜对去甲肾上腺素及5-HT的再摄取